属于烷化剂，能破坏DNA的抗肿瘤药物是
A. 来曲唑
B. 环磷酰胺
C. 厄洛替尼
D. 长春新碱
E. 多柔比星

正确答案：B。环磷酰胺

解析：本题考查抗肿瘤药。属于烷化剂，能破坏DNA的抗肿瘤药物是环磷酰胺（B对）。环磷酰胺是直接破坏DNA结构的烷化剂，通过与细胞中DNA发生共价结合来使DNA分子失活或断裂，可以损坏任何细胞增殖周期的DNA，对细胞有直接毒性作用。主要适用于恶性淋巴瘤、急性或慢性淋巴细胞白血病、多发性骨髓瘤，还可以用于自身免疫性疾病的治疗。来曲唑（A错）属于芳香氨酶抑制剂，芳香氨酶抑制剂通过抑制芳香化酶的活性，阻断卵巢以外的组织雄烯二酮及睾酮经芳香化作用转化成雌激素，达到抑制乳癌细胞生长，治疗肿瘤的目的。由于其不能抑制卵巢功能，故不能用于绝经前乳腺癌患者。厄洛替尼（C错）属于酪氨酸激酶抑制剂的抗肿瘤药物，主要用于表皮生长因子受体（EGFR）基因具有敏感突变的局部晚期或转移性非小细胞肺癌（NSCLC）患者的治疗，包括一线治疗、维持治疗和既往接受过至少一次化疗进展后的二线及以上治疗。长春新碱（D错）属于微管蛋白活性制剂的抗肿瘤药物，作用机制为与微管蛋白结合，抑制微管聚合，从而使纺锤丝不能形成，细胞有丝分裂停止于中期，属细胞周期特异性药物，主要作用于M期细胞。此外还可干扰蛋白质合成和RNA多聚酶，对G₁期细胞也有作用。临床用于急性白血病，尤其是儿童急性白血病，对急性淋巴细胞白血病疗效显著；恶性淋巴瘤；生殖细胞肿瘤；小细胞肺癌、尤文肉瘤、肾母细胞瘤、神经母细胞瘤；乳腺癌、慢性淋巴细胞白血病、消化道癌、黑色素瘤及多发性骨髓瘤等。多柔比星（E错）为干扰转录过程和阻止RNA合成的药物，抗瘤谱广，用于恶性淋巴瘤、乳腺癌、支气管肺癌和软组织肉瘤、成骨肉瘤、横纹肌肉瘤、尤文肉瘤、肾母细胞瘤、神经母细胞瘤等实体瘤。